促进健康的行为不包括
A. 戒除不良嗜好
B. 预警行为
C. 违规行为
D. 合理利用卫生服务
E. 日常健康行为

正确答案：C。违规行为